交感神经兴奋可引起
A. 瞳孔缩小
B. 逼尿肌收缩
C. 肠蠕动增强
D. 心率加快
E. 支气管平滑肌收缩

正确答案：D。心率加快